妇人行经腹痛常见的病因病机有
A. 气滞血瘀
B. 寒凝胞脉
C. 气血亏虚
D. 热入血脉
E. 痰浊阻络

正确答案：A、B、C。气滞血瘀；寒凝胞脉；气血亏虚

解析：本题考查的是月经变化的临床意义。妇人行经腹痛常见的病因病机有气滞血瘀（A对）、寒凝胞脉（B对）与气血亏虚（C对）。行经腹痛的临床意义：行经时腰腹作痛，甚至剧痛不能忍受，并随月经周期持续发作，称为痛经。经前或经期小腹胀痛者，多属气滞血瘀；小腹冷痛，遇暖则缓者，多属寒凝；行经或经后小腹隐痛、腰酸痛者，乃气血亏虚，胞脉失养所致。